女，22岁，突发腹痛12小时。腹痛呈持续性，先以脐部为主，后固定于右下腹，逐渐加重，伴恶心，无呕吐。查体：T37.5℃，P100次／分，R22次／分，BP110/70mmHg。痛苦面容，双肺未闻及啰音，心律齐。腹软，右下腹压痛，无反跳痛，Murphy征阴性，肝脾肋下未触及，肠鸣音减弱。血常规：Hb120g/L，WBC13×10⁹/L，N0.85，Plt200×10⁹/L。拟行手术治疗。如该患者为妊娠期，以下处理不正确的是
A. 手术切口需偏高
B. 围手术期应加用黄体酮
C. 临产期可行剖宫产同时切除阑尾
D. 常规放置引流管
E. 术后使用广谱抗生素

正确答案：D。常规放置引流管

解析：成年女性患者，突发腹痛12小时。腹痛呈持续性，先以脐部为主，后固定于右下腹，逐渐加重，伴恶心，无呕吐。腹软，右下腹压痛，无反跳痛，Murphy征阴性（排除急性胆囊炎），肝脾肋下未触及，肠鸣音减弱。如该患者为妊娠期。综合患者的症状、体征和辅助检查，初步诊断为妊娠期急性阑尾炎。妊娠期急性阑尾炎若不及时治疗，炎症发展易导致流产或早产，威胁母子生命安全，故宜早期手术，临产期可行剖宫产同时切除阑尾（C对）。手术切口需偏高（A对），以减少对子宫的刺激。围手术期应加用黄体酮（B对）保胎。尽量不用腹腔引流（D错，为本题正确答案）。术后使用广谱抗生素（E对），防止感染性疾病的发生。